最容易发生房室传导阻滞的是
A. 急性前壁心肌梗死
B. 急性前间壁心肌梗死
C. 急性高侧壁心肌梗死
D. 急性后壁心肌梗死
E. 急性下壁心肌梗死

正确答案：E。急性下壁心肌梗死

解析：一般情况下，右冠状动脉发出房室结支支配房室结。当右冠状动脉阻塞时，除导致急性下壁心肌梗死外，常导致房室结缺血，引起房室结及房室束缺血、水肿及炎症，极易造成房室传导阻滞。因此最易引起房室传导阻滞的是急性下壁心肌梗死（E对BCD错）。急性前壁心肌梗死（A错）易发生室性心律失常，其中以室性期前收缩最多见。